真核生物mRNA结构的特点除外的是
A. 5′-末端有帽子（cap）结构
B. 3′-端绝大多数均带有多聚腺苷酸（polyA）尾巴
C. 分子中可能有修饰碱基
D. mRNA分子链不被修饰
E. 分子中有编码区与非编码区

正确答案：D。mRNA分子链不被修饰

解析：真核生物mRNA结构的特点：①5′-末端有帽子（cap）结构。②3′-端绝大多数均带有多聚腺苷酸（polyA）尾巴。③分子中可能有修饰碱基，主要是甲基化，如m6A。④分子中有编码区与非编码区。掌握“RNA”知识点。